患者，女，56岁，身高156cm，体重61kg。空血糖7.8mmol/L，餐后血糖11.2mmol/L，糖化血红蛋白6.7%。4年后，该患者新诊断为浸润型肺结核，糖尿病相关检查：空腹血糖11.2mmol/L，餐后血糖18.3mmol/L，糖化血红蛋白9.2%，胰岛素分泌不足。宜选用的糖尿病治疗方案是
A. 换用胰岛素治疗
B. 增加现用降糖药的剂量
C. 换用其它作用机制的口服降糖药
D. 增加一种口服降糖药
E. 联合使用双胍类、磺酰脲类和α-葡萄糖苷酶抑制剂

正确答案：A。换用胰岛素治疗

解析：本题考查胰岛素分泌不足。胰岛素分泌不足可选用胰岛素（A对）注射给药，或与α-葡萄糖苷酶抑制剂、双胍类降糖药联合使用。1型糖尿病患者需依赖胰岛素维持生命，也必须使用胰岛素控制高血糖，并降低糖尿病并发症的发生风险。2型糖尿病患者虽不需要胰岛素来维持生命，但当口服降糖药效果不佳或存在口服药使用禁忌时，仍需应用胰岛素控制高血糖，并降低糖尿病并发症的发生危险。